与戴入局部义齿后基牙疼痛无关的因素是
A. 基托伸展过长
B. 基托与基牙接触过紧
C. 支托上有高点
D. 卡环过紧
E. 设计不当基牙受力过大

正确答案：A。基托伸展过长

解析：基牙疼痛：先检查基牙有无龋病或牙周病，如基牙正常，可能因基牙受力过大而导致疼痛，如卡环、基托与基牙接触过紧。（牙合）支托上有高点会影响（牙合）关系，也会引起基牙疼痛。而基托伸展过长，影响的是黏膜和义齿的固位。掌握“局部义齿修复后出现的问题及处理”知识点。